以下不是队列研究基本特点的是
A. 属于观察法
B. 设立对照组
C. 随机分配暴露因素
D. 因果时序合理
E. 能够直接计算相对危险度

正确答案：C。随机分配暴露因素